不寐的病机特点为
A. 阳盛阴衰，阴阳失交
B. 阴盛阳衰，阴阳失交
C. 胃气不和，夜卧不安
D. 阳不交阴，心肾不交
E. 痰热内扰，上扰心神

正确答案：A。阳盛阴衰，阴阳失交

解析：不寐的基本病机由情志所伤、饮食失节、劳逸失调、久病体虚等导致脏腑机能紊乱，气血失和，阴阳失调，即阴虚不能纳阳，或阳虚不得入于阴（A对）。